患者因反复出现皮肤出血，感染，贫血而就诊，检查后被确诊为慢性再障，最不可能出现的检查结果是：
A. 出血时间延长
B. 凝血时间延长
C. 网织红细胞百分比正常
D. 毛细血管脆性试验阳性
E. 红细胞形态大小均正常

正确答案：C。网织红细胞百分比正常

解析：本例患者为慢性再障患者，因为网织红细胞百分比＜0.01是再障的诊断标准之一，故慢性再障患者最不可能出现的检查结果是网织红细胞百分比正常（C错，为本题正确答案）。出血时间主要受血小板数量与功能影响，慢性再障患者血小板常减少，可表现为延长（A对）。凝血时间主要受内源性凝血途径影响，部分慢性再障患者可激发内源性凝血因子缺乏，可表现为延长（B对）。毛细血管脆性试验主要与血管壁功能状态有关，部分慢性再障患者血管壁功能受损，可表现为阳性（D对）。慢性再障患者血象表现为正细胞正色素性贫血，故红细胞形态大小均正常（E对）。